急性假膜型念珠菌口炎多发于
A. 老年人
B. 青少年
C. 新生婴儿
D. 更年期妇女
E. 40岁左右的中年人

正确答案：C。新生婴儿

解析：可发生于任何年龄的人，多见于长期使用激素、HIV感染者、免疫缺陷者、婴幼儿及衰弱者。但以新生儿最多见，发生率为4%，又称新生儿鹅口疮或雪口病。掌握“口腔念珠菌病”知识点。